胸骨左缘第2肋间闻及收缩期杂音，应考虑为
A. 主动脉瓣狭窄
B. 肺动脉瓣狭窄
C. 二尖瓣狭窄
D. 三尖瓣狭窄
E. 房间隔缺损

正确答案：B。肺动脉瓣狭窄

解析：胸骨左缘第2肋间为肺动脉瓣听诊区，闻及收缩期杂音应考虑为肺动脉瓣狭窄（B对）。